局限型青少年牙周炎好发牙是
A. 上颌切牙
B. 下颌切牙
C. 前磨牙和上下切牙
D. 第一磨牙和上下切牙
E. 第二磨牙和上下切牙

正确答案：D。第一磨牙和上下切牙

解析：本题考查局限型青少年牙周炎的好发牙位。1999年新分类法规定，局限型青少年牙周炎归为局限型侵袭性牙周炎，局限型青少年牙周炎患者典型的患牙局限于第一磨牙和上下切牙（D对），多为左右对称。